患者外感风寒，恶寒发热，头身疼痛，无汗，喘咳，治疗宜选用
A. 麻黄
B. 桂枝
C. 细辛
D. 杏仁
E. 白前

正确答案：A。麻黄

解析：患者外感风寒，恶寒发热，头身疼痛，无汗，为外感风寒表实证，又有喘咳的症状，用能够发散风寒，宣肺平喘的麻黄治疗（A对）。桂枝（B错）的功效是发汗解肌，温通经脉，助阳化气，平降冲逆。细辛（C错）的功效是解表散寒，祛风止痛，宣通闭窍，温肺化饮。杏仁（D错）的功效是降气止咳平喘，润肠通便。白前（E错）的功效是降气、止咳、平喘。